6岁，女孩。出生后反复呼吸道感染，平时少活动。体检：无发绀，心前区稍隆起，胸骨左缘3～4肋间Ⅲ级粗糙全收缩期杂音，伴震颤，P₂轻度亢进。最可能的诊断是
A. 房间隔缺损
B. 室间隔缺损
C. 动脉导管未闭
D. 法洛四联症
E. 肺动脉狭窄

正确答案：B。室间隔缺损

解析：患儿出生后反复呼吸道感染，提示肺部循环血量高，有血液淤积；P2亢进进一步提示肺动脉压力高，考虑存在左向右分流；胸骨左缘3-4肋间Ⅲ级粗糙全收缩期杂音提示病变在室间隔，诊断为室间隔缺损（B对）。患儿无发绀，故排除法洛四联症（D错）。患儿虽有轻度肺动脉压力增高，但P2轻度亢进是由肺动脉血流量增加引起，肺动脉狭窄（E错）时虽有肺动脉压力增高但肺部血流量减少。